具有通便解毒退黄止咳功效的药物是
A. 虎杖
B. 牛膝
C. 郁金
D. 大黄
E. 栀子

正确答案：A。虎杖

解析：虎杖味苦、性微寒，归肝、胆、肺经，其功效为利湿退黄，清热解毒，散瘀止痛，化痰止咳（A对）。牛膝的功效为逐瘀通经，补肝肾，强筋骨，利尿通淋，引血下行（B错）。郁金的功效为活血止痛，行气解郁，清心凉血，利胆退黄（C错）。大黄的功效为泻下攻积，清热泻火，凉血解毒，止血，逐瘀通经，利湿退黄（D错）。栀子的功效为泻火除烦，清热利湿，凉血解毒；外用消肿止痛（E错）。